引起人类猫抓病的病原体是
A. 布鲁菌
B. 鸟-胞内分枝杆菌
C. 贝纳柯克斯体
D. 汉塞巴通体
E. 五日热巴通体

正确答案：D。汉塞巴通体